强心苷治疗心功能不全疗效最好的适应证是
A. 甲状腺功能亢进诱发的心功能不全
B. 高度二尖瓣狭窄诱发的心功能不全
C. 伴有心房纤颤和心室率快的心功能不全
D. 肺源性心脏病引起的心功能不全
E. 严重贫血诱发的心功能不全

正确答案：C。伴有心房纤颤和心室率快的心功能不全